低钙血症对机体的影响哪一项不存在？
A. 神经肌肉兴奋性增高
B. 心肌兴奋性、传导性升高
C. 骨质钙化障碍
D. 心肌收缩性增强
E. 婴幼儿免疫力低下

正确答案：D。心肌收缩性增强

解析：Ca2＋参与维持神经-肌肉的兴奋性，当血浆Ca2＋的浓度降低时，神经-肌肉的兴奋性增高（A对）。Ca2＋对心肌细胞 Na＋内流具有竞争性抑制作用，称为膜屏障作用，低血钙时膜屏障作用减小，心肌兴奋性和传导性升高（B对）。钙参与成骨功能，低钙血症时骨质钙化障碍可引起佝偻病（C对）。低钙血症引起心肌收缩性减弱（D错，为本题正确答案）而不是增强。低钙血症可导致婴幼儿免疫力低下（E对）。